职业性疾病研究中的健康工人效应是由
A. 排除偏倚
B. 选择偏倚
C. 易感性偏倚
D. 测量偏倚

正确答案：C。易感性偏倚

解析：本题考查职业性疾病研究中的健康工人效应。职业性疾病研究中的健康工人效应是由易感性偏倚（C对ABD错）引起的。观察对象可能因各种主客观原因不同，暴露于危险因素的概率不同，使得各比较组对所研究疾病的易感性有差异，从而可能夸大或缩小了暴露因素与疾病的关联强度，导致某因素与某疾病间的虚假联系，由此而产生的偏倚称为易感性偏倚。